男，35岁。因5天来右下后牙肿痛，今日全身不适来就诊。查患者痛苦面容，右面颊部肿胀较明显。右下第一前磨牙远中颈部龋深穿髓，无探痛，Ⅲ度松动，叩痛（+++），龈红肿明显，移行沟变平。该患牙最可能的诊断为
A. 急性牙周脓肿
B. 急性牙槽脓肿
C. 急性间隙感染
D. 急性化脓性牙髓炎
E. 急性颌骨骨髓炎

正确答案：B。急性牙槽脓肿

解析：本题考查急性化脓性根尖周炎。患者有痛苦面容，Ⅲ度松动，叩痛（+++），龈红肿明显，移行沟变平，是急性牙槽脓肿（B对）的典型表现，做体温检测、白细胞数目检测、扪诊颌下淋巴结即可确诊。急性牙周脓肿（A错）有深迂回曲折的牙周袋，牙槽嵴出现骨质破坏，牙髓多有活力。急性间隙感染（C错）表现颌下三角区肿胀，下颌骨下缘轮廓消失，皮肤紧张，压痛。急性化脓性牙髓炎（D错）可有搏动性跳痛，往往夜间发作，疼痛呈放射状或牵扯性，遇冷刺激疼痛缓解，疼痛时间长，间隔时间短。急性颌骨骨髓炎（E错）患区病源牙及邻近牙常出现松动。